上列Hill准则的5条标准中，属于判断因果关系的特异标准的是
A. 关联强度
B. 生物学合理性
C. 结果的一致性
D. 实验证据
E. 特异性

正确答案：A。关联强度

解析：本题考查希尔准则的关联强度。本题Hill准则的5条标准中，属于判断因果关系的特异标准的是关联强度（A对BCDE错），该指标也是任何一项关于因果关系的流行病学研究必须提供的信息。